甲型流感病毒亚型划分的依据是
A. 核蛋白
B. 基质蛋白
C. 血凝素
D. 神经氨酸酶
E. 血凝素和神经氨酸酶

正确答案：E。血凝素和神经氨酸酶

解析：甲型流行性感冒病毒包膜，表面有两种病毒编码的糖蛋白刺突，分别为血凝素（HA）和神经氨酸酶（NA）。为甲型流感病毒亚型划分的依据，其抗原性易发生变异。掌握“正、副黏病毒”知识点。